呈不规则的段，灰绿色或灰棕色，茎细而卷曲，叶对生，多破碎，花单生或对生于叶腋，多具梗，蒴果扁球形，顶端具4枚宿存的萼齿；气微，味淡的饮片是
A. 紫花地丁
B. 白花蛇舌草
C. 香薷
D. 半枝莲
E. 荆芥

正确答案：B。白花蛇舌草

解析：本题考查白花蛇舌草的性状鉴别。白花蛇舌草（B对）【性状鉴别】药材扭缠成团状，灰绿色或灰棕色。主根1条，须根纤细。茎细而卷曲，具纵棱。叶对生，多破碎，极皱缩，易脱落，完整叶片线形；有托叶，长1～2mm，膜质，下部联合，顶端有细齿。花单生或对生于叶腋，多具梗。蒴果扁球形，顶端具4枚宿存的萼齿。气微，味淡。紫花地丁（A错）【性状鉴别】药材多皱缩成团。主根长圆锥形，直径1～3mm；淡黄棕色，有细纵皱纹。叶基生，灰绿色，展平后叶片呈披针形或卵状披针形，长1.5～6cm，宽1～2cm；先端钝，基部截形或稍心形，边缘具钝锯齿，两面有毛；叶柄细，长2～6cm，上部具明显狭翅。花茎纤细；花瓣5，紫堇色或淡棕色；花距细管状。蒴果椭圆形或3裂，种子多数，淡棕色。气微，味微苦而稍黏。香薷（C错）【性状鉴别】药材青香薷：长30～50cm，基部紫红色，上部黄绿色或淡黄色，全体密被白色茸毛。茎方柱形，基部类圆形，直径1～2mm，节明显，节间长4～7cm；质脆，易折断。叶对生，多皱缩或脱落，叶片展平后呈长卵形或披针形，暗绿色或黄绿色，边缘有3～5疏浅锯齿。穗状花序顶生及腋生，苞片圆卵形或圆倒卵形，脱落或残存；花萼宿存，钟状，淡紫红色或灰绿色，先端5裂，密被茸毛。小坚果4，直径0.7～1.1mm，近圆球形，具网纹。气清香而浓，味微辛而凉。半枝莲（D错）【性状鉴别】药材长15～35cm，无毛或花轴上疏被毛。根纤细。茎丛生，较细，方柱形；表面暗紫色或棕绿色。叶对生，有短柄；叶片多皱缩，展平后呈三角状卵形或披针形，长1.5～3cm，宽0.5～1cm；先端钝，基部宽楔形，全缘或有少数不明显的钝齿；上表面暗绿色，下表面灰绿色。花单生于茎枝上部叶腋，花萼裂片钝或较圆；花冠二唇形，棕黄色或浅蓝紫色，长约1.2cm，被毛。果实扁球形，浅棕色。气微，味微苦。荆芥（E错）【性状鉴别】药材茎方柱形，上部有分枝，长50～80cm，直径0.2～0.4cm；表面淡黄绿色或淡紫红色，被短柔毛；体轻，质脆，断面类白色。叶对生，多已脱落，叶片3～5羽状分裂，裂片细长。穗状轮伞花序顶生，长2～9cm，直径约0.7cm。花冠多已脱落，宿萼钟形，顶端5齿裂，淡棕色或黄绿色，被短柔毛；小坚果4，矩圆状三棱形，棕黑色。气芳香，味微涩而辛凉。